牙龈疾病中最常见的是
A. 多发性龈脓肿
B. 单发性龈脓肿
C. 龈乳头炎
D. 慢性龈炎
E. 牙龈增生

正确答案：D。慢性龈炎

解析：本题考查最常见的牙龈疾病。慢性龈炎（D对）的患病率高，涉及的人群广，几乎每个人在其一生中的某个时间段都可发生不同程度和不同范围的慢性龈炎，所以慢性龈炎是菌斑性牙龈病中最常见的。多发性龈脓肿（A错）是一种比较少见的临床症状较重的化脓性牙龈病损，局限于龈乳头，主要发生于青壮年男性，患病前大多已有全口性的慢性龈炎，当身体抵抗力减低，如在感冒发热、过度疲劳、睡眠不足等情况下，局部细菌大量繁殖和毒力增强，便可发生本病。单发性龈脓肿（B错）也是一种比较少见化脓性牙龈病损，发生于遭受机械创伤并继发感染的个别龈乳头。龈乳头炎（C错）是一种较为常见的牙龈病损，但不如慢性龈炎常见，当牙龈乳头受到机械或化学的刺激时才会引起本病。有牙龈增生（E错）症状的牙龈病根据病因可分为药物性牙龈增生、炎症性牙龈增生、牙龈纤维瘤病、白血病性牙龈肿大，但这些牙龈病少见，所以牙龈增生不是最常见的牙龈疾病。